氯丙嗪不会促使哪种激素的分泌
A. 催乳素
B. 促卵泡激素
C. 黄体生成素
D. ACTH
E. 生长激素

正确答案：E。生长激素

解析：氯丙嗪对内分泌系统的影响：结节-漏斗系统中的D2亚型受体可促使下丘脑分泌多种激素，如催乳素释放抑制因子、促卵泡激素释放因子、黄体生成素释放因子和ACTH等。也可抑制垂体生长激素的分泌。掌握“氯丙嗪”知识点。